女，36岁。春节乘长途汽车回家途中，突然感到心前区发闷、呼吸困难、出汗，觉得自己要不行了，不能自控，要发疯，为此感到紧张、害怕，立即被送到医院急诊。未经特殊处理，半小时后症状消失。体格检查正常。该患者长期治疗应首选的药物是
A. 帕罗西汀
B. 氨茶碱
C. 普萘洛尔
D. 苯乙肼
E. 地西泮

正确答案：A。帕罗西汀

解析：该患者春节回家途中突然感到心前区发闷，呼吸困难、出汗（自主神经功能紊乱症状），不能自控，感到紧张、害怕，未经特殊处理，半小时后症状消失（终止迅速），体格检查正常，故诊断为惊恐发作。长期治疗应首选帕罗西汀（5-羟色胺再摄取抑制剂，SSRIs）（A对），长期服用SSRIs能明显降低患者的复发率。地西泮（苯二氮䓬类药物）长期使用易导致依赖（E错）。